膈
A. 肌腹在中心，腱膜在四周
B. 食管裂孔平第8胸椎水平
C. 腔静脉裂孔位置最低
D. 主动脉裂孔有胸导管通过
E. 均不对

正确答案：D。主动脉裂孔有胸导管通过

解析：膈肌的周边是肌性部，中央为腱膜，并非肌腹在中心，腱膜在四周（A错）。食管裂孔平第10胸椎水平，而非第8胸椎水平（B错）。腔静脉裂孔位置最高，而非最低（C错）。主动脉裂孔有胸导管通过（D对）。